溶栓药的作用机制是
A. 血栓素A₂（TXA₂）
B. 凝血酶
C. 血小板
D. 抗凝血酶Ⅰ（AT-Ⅲ）
E. 纤溶酶原

正确答案：E。纤溶酶原

解析：本题考查纤溶酶原。正常情况下，血浆中纤溶酶原（E对）没有活性，可通过溶栓酶被激活，转变成具有催化活性的纤溶酶。